某女，80岁。体胖湿重多痰，患耳聋、耳鸣5年。近日又见湿浊中阻之脘腹痞满。治当开窍、化湿和胃，宜选用的药是
A. 石菖蒲
B. 砂仁
C. 半夏
D. 苏合香
E. 安息香

正确答案：A。石菖蒲

解析：本题考查的是石菖蒲的功效。体胖湿重多痰，患耳聋、耳鸣5年。近日又见湿浊中阻之脘腹痞满。治当开窍、化湿和胃，宜选用的药是石菖蒲（A对）。石菖蒲：【功效】开窍宁神，化湿和胃。砂仁（B错）：【功效】化湿行气，温中止泻，安胎。半夏（C错）：【功效】燥湿化痰，降逆止呕，消痞散结。苏合香（D错）：【功效】开窍辟秽，止痛。安息香（E错）：【功效】开窍辟秽，行气活血，止痛。